智能文化影响人类健康的主要途径是
A. 行为和生活方式
B. 精神和生活方式
C. 生活环境和劳动条件
D. 物质生活和精神条件
E. 劳动能力和劳动条件

正确答案：C。生活环境和劳动条件

解析：本题考查智能文化影响人类健康的主要途径。智能文化包括科学技术、生产生活知识等，主要通过影响生活环境和劳动条件（C对ABDE错）作用于人群健康。